《药品经营许可证管理办法》适用于《药品经营许可证》的
A. 验收
B. 发证
C. 换证
D. 变更
E. 监督管理

正确答案：B、C、D、E。发证；换证；变更；监督管理